3岁男童，发育迟缓、消瘦、体重过轻，诊断为干瘦型营养不良症，其原因是
A. 蛋白质严重缺乏
B. 必需脂肪酸严重缺乏
C. 能量严重缺乏
D. 蛋白质与必需脂肪酸同时严重缺乏
E. 蛋白质和能量同时严重缺乏

正确答案：E。蛋白质和能量同时严重缺乏